通过阻断药物α₁受体而降低外周血管阻力的药物是
A. 卡托普利
B. 阿替洛尔
C. 哌唑嗪
D. 氯沙坦
E. 氢氯噻嗪

正确答案：C。哌唑嗪

解析：本题考查哌唑嗪。通过阻断药物α₁受体而降低外周血管阻力的药物是哌唑嗪（C对）。哌唑嗪选择性阻滞血管平滑肌突触后膜的α₁受体，使小动脉、小静脉扩张而产生中等偏强的降压作用。卡托普利（A错）为血管紧张素转换酶抑制剂（ACEI）。阿替洛尔（B错）为β₁受体阻滞剂。氯沙坦（D错）属于血管紧张素Ⅱ受体阻断剂（ARB）。氢氯噻嗪（E错）是中效利尿剂。